主要减少肝糖输出的药物是
A. 阿卡波糖
B. 胰岛素
C. 格列美脲
D. 吡格列酮
E. 二甲双胍

正确答案：E。二甲双胍

解析：二甲双胍（E对）可明显降低糖尿病患者的血糖，对正常人血糖无明显影响，其作用机制是促进脂肪组织摄取葡萄糖，降低葡萄糖在肠的吸收及糖原异生（E对）（肝糖输出主要是肝糖原输出，二甲双胍类药物抑制肝糖原异生，减少肝糖输出）抑制胰高血糖素释放等。阿卡波糖（A错）（P355）是α-葡萄糖苷酶抑制剂，延缓碳水化合物的水解和葡萄糖的吸收。为胰岛素（B错）（P349）主要促进血糖的去路，抑制血糖的来源，来发挥降血糖的作用。格列美脲（C错）属于磺酰脲类，属于促分泌剂，刺激胰岛B细胞释放胰岛素来发挥降血糖的作用。吡格列酮（D错）（P354）属于胰岛素增敏剂，改善B细胞功能，显著改善胰岛素抵抗。